正态分布的数值变量，两组资料的比较，检验统计量的计算用
A. （x-μ）/σ
B. （x-μ）/σx
C. （x-μ）/Sx
D. （d-μ）/Sd
E. （X1-X2）/S（x1-x2）

正确答案：E。（X1-X2）/S（x1-x2）

解析：本题通过比较两组资料正态分布的数值变量，属于两独立样本均数t检验，其统计量计算公式为（X1-X2）/S（x1-x2）（E对）。（x-μ）/σ（A错）、（x-μ）/σx（B错）属于化为标准正态分布的计算，不符合题意。（x-μ）/Sx（C错）是单样本t检验统计量计算公式，不符合题意。（d-μ）/Sd（D错）是配对t检验统计量计算公式，不符合题意。